地方性克汀病是由于
A. 婴儿期摄入氟过多所致
B. 母体妊娠期间摄入过多非必需微量元素所致
C. 胚胎期和婴儿期碘摄入过多所致
D. 胚胎发育期和婴儿期严重缺碘所致
E. 胚胎期和婴儿期多种微量元素严重缺乏所致

正确答案：D。胚胎发育期和婴儿期严重缺碘所致

解析：本题考查地方性克汀病的发病机制。地方性克汀病原系指欧洲阿尔卑斯山区常见的一种体格发育落后、痴呆和聋哑的疾病。患者生后即有不同程度的智力低下，体格矮小，听力障碍，神经运动障碍和甲状腺功能低下，伴有甲状腺肿。地方性克汀病发病是由于胚胎发育期和婴儿期严重缺碘所致（D对ABCE错）。